下颌骨骨折的临床愈合所需时间
A. 4～6周
B. 5～7周
C. 6～8周
D. 7～9周
E. 3个月

正确答案：C。6～8周

解析：在骨内、外骨痂和桥梁骨痂完全骨化、愈合后，其强度已能承受因肌收缩或外力引起的应变力量时，即达到骨折的临床愈合，下颌骨骨折的临床愈合所需时间通常为6～8周。掌握“颧骨及颧弓、眼眶骨折及骨折愈合过程”知识点。